供水单位换发新卫生许可证的申请，应在有效期满前（）提出
A. 3个月
B. 4个月
C. 5个月
D. 6个月
E. 7个月

正确答案：D。6个月